患者34岁，心前区反复疼痛及气短3年，血压20.0/4.0kPa（150/30mmHg），心脏呈靴型增大。以下何项检查不与本病符合
A. 胸骨右缘2肋间扪及明显收缩期震颤
B. 肱动脉枪击音
C. 交替脉
D. 心尖区闻及舒张期杂音
E. 水冲脉

正确答案：A。胸骨右缘2肋间扪及明显收缩期震颤